上颌义齿形成良好的后缘封闭的区域是
A. 主承托区
B. 副承托区
C. 缓冲区
D. 边缘封闭区
E. 后堤区

正确答案：E。后堤区

解析：上颌义齿后堤区：是上颌义齿基托后缘向组织方向高出的部分，当义齿在口内就位后，义齿后堤与软硬腭交界处的黏膜组织紧密接触，防止空气进入，形成良好的后缘封闭，有利于义齿的固位。掌握“无牙颌的解剖标志及功能分区”知识点。